尘肺是一种
A. 肺部疾病
B. 以纤维化为主的疾病
C. 纤维化疾病
D. 粉尘引起的免疫性疾病
E. 炎症

正确答案：B。以纤维化为主的疾病

解析：本题考查尘肺的概念。尘肺又叫肺尘埃沉着病，是由于在生产环境中长期吸入生产性粉尘而引起的以肺组织纤维化为主的疾病（B对ACDE错）。其最主要的特点是会引起肺部组织纤维化。